以下有关荚膜的叙述中不恰当的是
A. 细胞壁外有一层厚≥0.2μm而黏稠的结构
B. 化学成分在多数菌为多肽
C. 具有黏附宿主细胞的作用
D. 有抗吞噬等致病作用
E. 是细菌的特殊结构

正确答案：B。化学成分在多数菌为多肽

解析：荚膜菌在其细胞壁外有一层厚≥0.2μm而黏稠的结构称为荚膜，其化学成分在多数菌为多糖，少数菌为多肽。荚膜具有黏附宿主细胞和抗吞噬等致病作用以及抗原性，并且是鉴别细菌的指征之一。掌握“细菌的特殊结构及检查方法”知识点。